男，20岁。右胸刀刺伤2小时就诊。既往体健。查体：T36.5℃,P120次/分，R24次/分，BP80/50mmHg，面色苍白，皮肤潮湿，右胸腋前线第5肋间2cm伤口，有血液流出，右胸叩诊实音，呼吸音减弱。急行胸腔闭式引流，引流出血性液体约500ml,3小时内又引流出血性液体700ml。最有效的处置措施是
A. 输液、输血
B. 开胸探查
C. 调整引流管位置
D. 镇静、吸氧
E. 气管插管呼吸机辅助呼吸

正确答案：B。开胸探查

解析：青年男性患者，右胸刀刺伤，伤口流血（提示为开放性损伤），P120次/分，BP80/50mmHg，提示患者已达中度休克，说明出血量大；右胸叩诊实音，呼吸音减弱，引流出血性液体约500ml，3小时内又引流出血性液体700ml，提示胸膜腔有持续性出血，结合患者病史、症状和体征，首先考虑的诊断是右侧进行性血胸。输液、输血（A错）虽然可以补充血容量，缓解当前休克症状，但不能从根本上解决失血的原因。对于进行性血胸患者最有效的处置措施是开胸探查（B对），寻找出血原因并止血，防止休克进展。患者引流通畅，故无需调整引流管位置（C错）。镇静、吸氧（D错）和气管插管呼吸机辅助呼吸（E错）均为一般性辅助治疗措施，对缓解当前持续性出血症状无效。